引起吸气性呼吸困难的疾病是
A. 气管肿瘤
B. 慢性阻塞性肺气肿
C. 支气管哮喘
D. 气胸
E. 大面积肺不张

正确答案：A。气管肿瘤

解析：肺源性呼吸困难可分为吸气性呼吸困难、呼气性呼吸困难及混合性呼吸困难。吸气性呼吸困难主要特点为吸气显著费力，严重者吸气时可见“三凹征”，常见于喉部、气管、大支气管的狭窄与阻塞，气管肿瘤（A对）可引起气管的阻塞，故引起吸气性呼吸困难。呼气性呼吸困难主要特点为呼气费力、呼气缓慢、呼吸时间明显延长，常伴呼气性哮鸣音，常见于慢性阻塞性肺气肿（B错）、支气管哮喘（C错）、弥漫性泛细支气管炎等。混合性呼吸困难主要特点为吸气期及呼气期均感呼吸费力、呼吸频率增快、深度变浅，可伴有呼吸音异常或病理性呼吸音，常见于气胸（D错）、大面积肺不张（E错）、重症肺炎、重症肺结核等。